引起老年人继发性膜性肾病最常见的病因是
A. 系统性红斑狼疮
B. 恶性肿瘤
C. 系统性血管炎
D. 过敏性紫癜
E. 乙肝病毒相关性肾小球肾炎

正确答案：B。恶性肿瘤

解析：引起老年人继发性膜性肾病的最常见的病因是糖尿病肾病，其次恶性肿瘤（B对）。系统性红斑狼疮、过敏性紫癜、乙肝病毒相关性肾小球肾炎均为儿童、青少年继发性肾病综合征的病因（ADE错）。无法确定系统性血管炎与肾病综合征是否有明确关联（C错）。